主要经消化道传播的病原体是
A. HIV
B. HBV
C. HAV
D. HSV
E. HPV

正确答案：C。HAV

解析：甲肝病毒（HAV）的传染源为急性期患者和隐性感染者，主要由粪-口途径传播。掌握“病毒传播方式、感染类型、致病机制及免疫”知识点。